长期大量服用维生素D，可能引起的不良反应是
A. 出血倾向
B. 皮肤干燥
C. 骨硬化
D. 体重增加
E. 视物模糊

正确答案：C。骨硬化

解析：本题考查维生素D的不良反应。维生素D能促进小肠对钙的吸收，促进肾小管重吸收磷和钙，导致骨内转移性钙沉积，长期大量使用可形成骨硬化（C对）。维生素K为肝脏合成凝血酶原的必需物质，缺乏时可引起凝血因子合成障碍，引起出血倾向（A错）。盐酸缺乏时可引起糙皮病，出现皮肤干燥（B错）等症状。长期服用维生素D会使体重下降（D错）。大量服用维生素E可引起视物模糊（E错）乳腺肿大等症状。